流脑的主要致病因子是
A. 肠毒素
B. 内毒素
C. 类毒素
D. 细胞毒素
E. 神经毒素

正确答案：B。内毒素

解析：细菌释放的内毒素是本病致病的重要因素（B对）。内毒素引起全身的施瓦茨曼反应，激活补体，血清炎症介质明显增加，导致循环障碍和休克。脑膜炎球菌内毒素较其他内毒素更易激活凝血系统，因此在休克早期便可出现弥散性血管内凝血及继发性纤溶亢进，进一步加重微循环障碍、出血和休克，最终造成多器官功能衰竭。